驾驶员驾车时，慎用的药品是
A. 右美沙芬
B. 甲睾酮
C. 非洛地平
D. 非诺贝特
E. 布洛芬

正确答案：A。右美沙芬

解析：本题考查特殊人群用药。右美沙芬（A对）属于中枢性镇咳药，其不良反应为嗜睡、眩晕，驾驶员服用后会影响反应能力。甲睾酮（B错）具有蛋白同化作用，运动员禁用。非洛地平（C错）属于钙通道阻滞剂，对驾驶员的正常反应无明显影响。非诺贝特（D错）属于贝特类调节血脂药，偶见口干、食欲减退、大便次数增多、皮疹、腹胀和白细胞减少等，哺乳期妇女禁用。布洛芬（E错）属于解热镇痛药，服后偶见头晕、头昏、头痛，少数人可出现视力降低和辨色困难，从而影响驾驶员的反应能力，因此服用布洛芬之后驾车应需注意。